胎儿能否衔接入盆的关键径线是
A. 坐骨棘间径
B. 入口前后径
C. 坐骨结节间径
D. 入口横径
E. 中骨盆前后径

正确答案：B。入口前后径

解析：入口前后径（B对）（耻骨联合上缘中点至骶岬上缘正中间的距离，正常值平均11cm）是胎先露部进入骨盆入口的重要径线，其长短与分娩关系密切。坐骨棘间径（P148）（A错）是中骨盆最短的径线，此径线过小会影响分娩过程中胎头的下降，而不是影响胎儿能否衔接入盆。坐骨结节间径（P146）（C错）直接测出骨盆出口的横径长度，影响胎头能否经阴道娩出，也不影响胎儿能否衔接入盆。入口横径（P170）（D错）是髂耻缘间的最大距离，不是胎儿能否衔接入盆的关键径线。中骨盆前后径（P170）（E错）是耻骨联合下缘中点通过两侧坐骨棘连线中点至骶骨下端间的距离，为衡量中骨盆大小的骨性指标。